冬季将至，北方地区开展年一度的流感疫苗的接种工作，随访期间90%的接种者未患流感，以下说法正确的是
A. 该疫苗有效，因为90%的接种者未患病
B. 尚不能下结论，因为无统计学检验结果
C. 该疫苗无效，因为部分接种者发生了流感
D. 不能下结论，因为只是北方地区的数据
E. 不能下结论，因为未设对照组

正确答案：E。不能下结论，因为未设对照组

解析：本题考查实验设计的对照原则。在研究干预措施的效果时，直接观察到的往往是多种因素的效应交织在一起的综合作用，合理的对照能成功地将干预措施的真实效应客观地、充分地暴露或识别出来，使研究者有可能作出正确评价。本题随访期间90%的接种者未患流感，没有对比考虑未接种者未患流感的情况，即未设对照组（E对ABCD错）。